T细胞分化、发育、成熟的场所是
A. 骨髓
B. 淋巴结
C. 胸腺
D. 脾脏
E. 黏膜淋巴组织

正确答案：C。胸腺

解析：胸腺是T细胞分化、发育、成熟的主要场所。从骨髓迁入T细胞前体（胸腺细胞）→皮质→髓质移行，在胸腺微环境经过阴性与阳性选择过程，约10%的胸腺细胞获得自身免疫耐受和限制性抗原识别能力，发育成熟为初始T细胞。掌握“中枢和外周免疫器官”知识点。